女，50岁，2小时前烧伤双侧臀部、双下肢（不包括双足），皮肤明显红肿，疼痛较剧，伤处布满大小水疱，内含黄色液体，去疱皮见创面红润、潮湿。血压等生命体征正常。其初期处理中不适合的是
A. 清创后创面全部包扎
B. 保留小水疱，消毒，不包扎
C. 大水疱消毒，抽去液体
D. 注射破伤风抗毒素
E. 按烧伤输液公式补液

正确答案：A。清创后创面全部包扎

解析：女性患者，双侧臀部（6%）、双下肢（不包括双足）（双大腿21%+双小腿13%），烧伤面积一共40%。患者局部红肿明显，疼痛明显，有大小不一的水疱形成，内含淡黄色液体，水疱皮剥脱后，创面红润、潮湿，烧伤深度为浅Ⅱ°，该患者烧伤深度及面积是浅Ⅱ°，40%。初期处理中可以：小水疱保留，消毒，不包扎（B对）；大水疱消毒，抽去液体（C对）；注射破伤风抗毒素（D对）；按烧伤输液公式补液（E对）。不适合：清创后创面全部包扎（A错，为本题正确答案），会加重感染，不利于愈合。